佩戴防护眼镜或面罩可以有效的
A. 防止飞沫的危害
B. 防止碎屑、唾液的化学物质伤害眼睛
C. 防止正畸治疗时剪断弹出的金属丝伤害眼睛
D. 防止飞溅的旧的充填物牙体伤害眼睛
E. 以上都正确

正确答案：E。以上都正确

解析：防护眼镜和面罩：在口腔治疗中产生的颗粒可能伤害到医师的眼睛，如飞溅的碎片、旧的充填物或崩裂的牙体；正畸治疗或义齿修复时剪断弹出的金属丝；使用高速手机、超声波洁牙机或水气枪时产生的喷雾、牙结石碎片等。配戴防护眼镜不仅可防止物理性损伤，也可以防止飞沫的危害，防止碎屑、唾液、飞溅的化学物质或其他气化物质伤害眼睛。防护眼镜可以用肥皂水、消毒液清洁，用流水冲洗干净后重复使用。掌握“患者、医务人员及环境的防护”知识点。